三焦经在上肢的循行部位是
A. 外侧前缘
B. 内侧中线
C. 外侧后缘
D. 内侧前缘
E. 外侧中线

正确答案：E。外侧中线

解析：该题考查十二经脉的分布规律，属记忆内容。三焦经又称为手少阳三焦经，分布于上肢外侧中线（E对）。上肢外侧前缘为手阳明大肠经（A错）。上肢内侧中线为手厥阴心包经（B错）。上肢外侧后缘为手太阳小肠经（C错）。上肢内侧前缘为手太阴肺经（D错）。记忆：阳经，前中后：阳少太。阴经，前中后：太厥少。